发生于舌下腺的最常见的肿瘤是
A. 腺淋巴瘤
B. 腺泡细胞癌
C. 混合瘤
D. 黏液表皮样癌
E. 腺样囊性癌

正确答案：E。腺样囊性癌

解析：腺样囊性癌最常见于腭部小唾液腺及腮腺，其次为下颌下腺，发生于舌下腺的肿瘤，多为腺样囊性癌。掌握“腺样囊性癌”知识点。